肾实质叙述错误的是
A. 分为肾皮质和肾髓质
B. 皮质由肾小体和肾小管构成
C. 髓质由15-20个肾锥体构成
D. 肾锥体尖朝向皮质
E. 皮质伸入肾锥体之间为肾柱

正确答案：D。肾锥体尖朝向皮质

解析：肾实质分为肾皮质和肾髓质（A对），皮质由肾小体与肾小管组成（B对），髓质由15-20个肾锥体构成（C对），肾锥体的底朝皮质、尖向肾窦（D错为，本题正确答案），伸入肾锥体之间的肾皮质称肾柱（E对）。